先兆流产的血瘀证的治疗方剂为
A. 寿胎丸
B. 胎元饮
C. 保阴煎
D. 桂枝茯苓丸合寿胎丸
E. 圣愈汤

正确答案：D。桂枝茯苓丸合寿胎丸

解析：先兆流产之血瘀证主因宿有癥瘕瘀血占据子宫，或孕后不慎跌扑闪挫，或孕期手术创伤，均致气血不和，瘀阻子宫、冲任，使胎元失养而不固，发为胎漏、胎动不安。治宜活血消癥，补肾安胎，方用活血化瘀之桂枝茯苓丸合补肾安胎之寿胎丸以使邪去胎安（D对）。先兆流产肾虚证的治疗方剂为寿胎丸（A错）；先兆流产气血虚弱证的治疗方剂为胎元饮（B错）；先兆流产血热证的治疗方剂为保阴煎（C错）；若妊娠期间不慎跌扑闪挫，继则腰腹疼痛，胎动下坠，阴道流血，精神倦怠，脉滑无力，治宜选用圣愈汤（E错）来益气养血，固肾安胎。